胚胎毒性作用是
A. 母体毒性，生长迟缓
B. 生长迟缓，功能缺陷
C. 生长迟缓，致畸作用
D. 功能缺陷，致畸作用
E. 致畸作用，致死作用

正确答案：B。生长迟缓，功能缺陷